男，40岁。痰中带血1个月，乏力、头晕1周。胸部X线片检查发现右肺门团块状影4cm×4cm。纤维支气管镜检查示右主支气管黏膜粗糙水肿，管腔狭窄，黏膜活检可见肿瘤细胞。对该患者首选的治疗方法是
A. 免疫治疗
B. 放疗
C. 手术治疗
D. 靶向药物治疗
E. 化疗

正确答案：E。化疗

解析：男，40岁。痰中带血1个月（常见于中心型肺癌），乏力、头晕1周。胸部X线片检查发现右肺门团块状影4cm×4cm。纤维支气管镜检查示右主支气管黏膜粗糙水肿，管腔狭窄，黏膜活检可见肿瘤细胞，该患者最有可能的诊断为小细胞肺癌，一般都有远处转移，不推荐手术治疗，最佳的治疗方法是化疗（E对）。